初产妇，妊娠39周，骨盆各径线为：对角径13cm，坐骨棘间径9.5cm，坐骨结节间径7cm，耻骨弓角度80°。若出口后矢状径为8.5cm，估计能经阴道分娩的条件是
A. 持续性枕后位
B. 估计胎儿体重2800g
C. 胎儿窘迫
D. 完全臀先露
E. 以上都不是

正确答案：B。估计胎儿体重2800g

解析：本例出口横径（坐骨结节间径）=7cm，出口后矢状径=8.5cn，两者之和＞15cm，多数可经阴道分娩。持续性枕后位（A错）和完全臀先露（D错）属于胎位异常，不一定能经阴道分娩。估计胎儿体重2800g（＜3000g）（B对E错）可经阴道分娩。胎儿窘迫应立即行剖宫产术结束分娩，以免胎死宫中（C错）。